抑制脱氧胸苷酸合成酶的药物是
A. 氟尿嘧啶
B. 阿糖胞苷
C. 羟基脲
D. 甲氨蝶呤
E. 巯嘌呤

正确答案：A。氟尿嘧啶

解析：本题考查干扰核酸生物合成的药物。抑制脱氧胸苷酸合成酶的药物是氟尿嘧啶（A对）。胸苷酸合成酶抑制剂有氟尿嘧啶、卡培他滨、替加氟等。阿糖胞苷（B错）为DNA多聚酶抑制剂。羟基脲（C错）为核苷酸还原酶抑制剂。甲氨蝶呤（D错）为二氢叶酸还原酶抑制剂。巯嘌呤（E错）为嘌呤核苷合成酶抑制剂。